《中国药典》2010年版一部规定，应检查重金属及有害元素的药材有
A. 山楂
B. 苦杏仁
C. 乌梅
D. 枸杞子
E. 山茱萸

正确答案：A、D。山楂；枸杞子

解析：本题考查的是中药有害物质的检测。《中国药典》2010年版一部规定，应检查重金属及有害元素的药材有山楂（A对）与枸杞子（D对）。重金属及有害元素：①重金属检查：矿物药如石膏、芒硝含重金属不得过10mg/kg，玄明粉不得过20mg/kg；动物药如地龙含重金属不得过30mg/kg；银杏叶提取物、黄芩提取物、连翘提取物含重金属不得过20mg/kg等。②砷盐检查：《中国药典》规定玄明粉含砷盐不得过20mg/kg，芒硝含砷盐不得过10mg/kg，石膏含砷盐不得过2mg/kg。③铅、镉、砷、汞、铜测定：《中国药典》规定甘草、黄芪、丹参、白芍、西洋参、金银花、枸杞子、山楂、阿胶、牡蛎、珍珠、蛤壳等含铅不得过5mg/kg，镉不得过0.3mg/kg，砷不得过2mg/kg，汞不得过0.2mg/kg，铜不得过20mg/kg。海螵蛸含铅不得过5mg/kg，镉不得过5mg/kg，砷不得过10mg/kg，汞不得过0.2mg/kg，铜不得过20mg/kg。